根据《麻醉药品和精神药品管理条例》规定，下列关于临床使用麻醉药品和第一类精神药品的说法，其错误的是
A. 具有麻醉药品和第一类精神药品处方资格的执业医师，对确需使用该类药品的患者，应当满足其合理用药需求
B. 在医疗机构就诊的癌症疼痛患者和其他危重患者得不到麻醉药品和第一类精神药品时，患者或者其亲属可以向执业医师提出申请
C. 具有麻醉药品和第一类精神药品处方资格的执业药师在得到患者或者亲属的申请后，应当及时为患者提供所需麻醉药品或第一类精神药品
D. 医疗机构抢救病人急需麻醉药品和第一类精神药品而本医疗机构无法提供时，可以从其他医疗机构或者定点批发企业紧急借用
E. 医疗机构配制的麻醉药品和精神药品制剂只能在本医疗机构使用

正确答案：C。具有麻醉药品和第一类精神药品处方资格的执业药师在得到患者或者亲属的申请后，应当及时为患者提供所需麻醉药品或第一类精神药品

解析：本题考查《麻醉药品和精神药品管理条例》。关于临床使用麻醉药品和第一类精神药品的说法错误的是具有麻醉药品和第一类精神药品处方资格的执业药师在得到患者或者亲属的申请后，应当及时为患者提供所需麻醉药品或第一类精神药品（C错，为本题的正确答案）。根据《麻醉药品和精神药品管理条例》规定，第三十九条具有麻醉药品和第一类精神药品处方资格的执业医师，根据临床应用指导原则，对确需使用麻醉药品或者第一类精神药品的患者，应当满足其合理用药需求（A对）。在医疗机构就诊的癌症疼痛患者和其他危重患者得不到麻醉药品或者第一类精神药品时，患者或者其亲属可以向执业医师提出申请（B对）。具有麻醉药品和第一类精神药品处方资格的执业医师认为要求合理的，应当及时为患者提供所需麻醉药品或者第一类精神药品。第四十二条医疗机构抢救病人急需麻醉药品和第一类精神药品而本医疗机构无法提供时，可以从其他医疗机构或者定点批发企业紧急借用（D对）；抢救工作结束后，应当及时将借用情况报所在地设区的市级药品监督管理部门和卫生主管部门备案。第四十三条对临床需要而市场无供应的麻醉药品和精神药品，持有医疗机构制剂许可证和印鉴卡的医疗机构需要配制制剂的，应当经所在地省、自治区、直辖市人民政府药品监督管理部门批准。医疗机构配制的麻醉药品和精神药品制剂只能在本医疗机构使用（E对），不得对外销售。